先按疾病状态，确定调查对象，选择有特定疾病的人群组，与未患这种疾病的对照组，比较两组人群过去暴露于某种可能危险因素的程度，分析暴露是否与疾病有关。此种调查方法为
A. 纵向研究
B. 常规资料分析
C. 横断面研究
D. 群组研究
E. 病例-对照研究

正确答案：E。病例-对照研究

解析：本题考查病例-对照研究的定义。先按疾病状态，确定调查对象，选择有特定疾病的人群组，与未患这种疾病的对照组，比较两组人群过去暴露于某种可能危险因素的程度，分析暴露是否与疾病有关。此种调查方法为病例-对照研究（E对）。它主要用于探讨病因或相关因素对疾病发生的影响。病例-对照研究的特点是观察时间短、需要研究的对象少，适合研究一些病程较长的慢性病和一些比较少见的疾病。纵向研究（A错）又称疾病监测，即研究疾病或某种情况在一个人群中随着时间推移的自然动态变化。常规资料分析（B错）又称历史资料分析，即对已有的资料或者疾病监测记录做分析或总结。横断面研究（C错）又称现况调查，调查目标人群中某种疾病或现象在某一特定时点的情况。群组研究（D错）又称队列研究，将特定人群按其是否暴露于某因素分为暴露组与非暴露组，追踪观察一段时间，比较两组的发病率，以检验该因素与某疾病病因的假设。